弦脉所主的病症有
A. 肝胆病
B. 实热
C. 痰饮
D. 瘀血
E. 痛证

正确答案：A、C、E。肝胆病；痰饮；痛证

解析：本题考查的是弦脉与主病。弦脉所主的病症有肝胆病（A对）、痰饮（C对）与痛证（E对）。弦脉与主病：［脉象］端直以长，如按琴弦。［主病］肝胆病、痛证、痰饮等。弦大兼滑，阳热为病；弦紧兼细，阴寒为病；虚劳内伤，中气不足，肝病乘脾，也常见弦脉；若弦而细劲，如循刀刃，便是全无胃气，病多难治。实热（B错）为数脉的主病。数脉与主病：［脉象］一息脉来五至以上（相当于每分钟脉搏在90次以上），“去来促急”。［主病］主热证。有力为实热，无力为虚热。瘀血（D错）是指体内局部血液的停滞，包括离经之血积存体内，或血运不畅，阻滞于经脉、脏腑及其他部位的血液，均称为瘀血。